治疗绿脓杆菌感染的药物是
A. 青霉素G
B. 羧苄青霉素
C. 两者均可
D. 两者均不可

正确答案：B。羧苄青霉素

解析：本题考查治疗绿脓杆菌感染的药物。羧苄青霉素（B对）可用于治疗绿脓杆菌感染。青霉素（AC错）对大多数革兰阳性、革兰阴性球菌及某些革兰阳性杆菌及螺旋体引起的感染有效，对大多数革兰阴性杆菌不敏感。